女，35岁。寒战、发热伴腰痛、尿频1天。查体：T39.2℃，左肾区叩击痛（+）。血WBC明显升高，尿液检查RBC25～30/高倍视野，WBC50～60/高倍视野，尿蛋白（+）。最可能的诊断是
A. 急性肾盂肾炎
B. 肾乳头坏死
C. 急性肾小管坏死
D. 急性间质性肾炎
E. 肾结核

正确答案：A。急性肾盂肾炎

解析：青年女性患者（急性肾盂肾炎好发人群），寒战、高热，腰痛、左肾区叩击痛，尿频1天（急性肾盂肾炎典型临床表现），血WBC明显升高，尿液检查：RBC25〜30/高倍视野（RBC正常值：<3个/高倍视野），WBC50〜60/高倍视野（WBC正常值：<5个/高倍视野），尿蛋白（+），综合患者的症状、体征、实验室检查，最可能的诊断是急性肾盂肾炎（A对）。肾乳头坏死（B错）是指在尿路梗阻或严重的小管间质性肾病基础上出现的发热、血尿、急性腰痛，尿路梗阻和绞痛，或伴长期多尿和夜尿。急性肾小管坏死（P513）（C错）患者多数可出现少尿和无尿，并且有肾功能减退和水、电解质和酸碱平衡紊乱的临床表现。急性间质性肾炎（P488）（D错）患者常有近期用药史，并有皮疹、发热及外周血嗜酸性粒细胞增多等药物过敏表现，伴尿检异常或肾小管及肾小球功能损害。肾结核（P495）（E错）常起病较慢，与肺结核、肠结核同时出现者多见，常伴低热、盗汗、食欲不振等全身中毒症状。